女性，18岁，右上颌骨肿物1年。手术切除标本为囊性，剖开见囊壁附着于牙颈部的牙冠，发育不完整的牙根位于囊壁外。囊壁上皮薄，含2～3层细胞，病理诊断是
A. 腺牙源性囊肿
B. 含牙囊肿
C. 成人龈囊肿
D. 牙源性角化囊肿
E. 根尖周囊肿

正确答案：B。含牙囊肿

解析：本题考查牙源性囊肿。含牙囊肿（B对）的病理特点是囊肿内含牙，囊壁附着于牙颈部。镜下的特点是上皮较薄，有2～3层细胞，类似于缩余釉上皮。其他的备选答案中个别囊肿内也可含牙，但不附着于牙颈部。